剂量过大或药物在体内蓄积过多时发生的不良反应属于
A. 特异质反应
B. 停药反应
C. 后遗效应
D. 毒性反应
E. 继发反应

正确答案：D。毒性反应

解析：本题考查毒性反应的定义。毒性反应（D对） 是指在剂量过大或药物在体内蓄积过多时发生的危害性反应。